治疗滞产、经闭等妇产科病证，应首选
A. 足三里
B. 至阴
C. 合谷
D. 血海
E. 太冲

正确答案：C。合谷

解析：合谷（C对）为大肠原穴，治头面五官诸疾、外感病、滞产、经闭等妇科病、热病无汗等诸多病症。因为合谷可以使气机向下，具有通下的功能，所以用来治疗滞产、经闭等妇产科病证，孕妇当慎用。足三里（A错）主治胃痛、腹泻等胃肠疾患、下肢肿痛麻木、虚劳羸弱；至阴主治：腰背疼痛、足指麻木、胎位不正等（B错）。血海（D错）主治月经不调、崩漏、经闭等妇科病，此外也可以治疗隐疹、丹毒、湿疹等皮肤病。太冲（E错）主治头痛、眩晕等肝阳上亢病症，胁痛、腹胀、遗尿、癃闭等肝气不舒的病症，以及月经不调、痛经、带下等妇科病，此外也可以治疗下肢痿痹等。